婴儿特殊的必需氨基酸是
A. 赖氨酸
B. 酪氨酸
C. 同型半胱氨酸
D. 组氨酸
E. 谷氨酸

正确答案：D。组氨酸